患者，某女，28岁，于冬季剖宫产一子，产后即有小腹疼痛，拒按，得热痛缓，恶露量少，涩滞不畅，色紫暗有块，四肢不温，舌质紫暗，脉沉紧。治法应为
A. 补益气血，缓急止痛
B. 调和气血，暖宫止痛
C. 疏肝解郁，理气止痛
D. 滋补肝肾，柔肝止痛
E. 活血化瘀，温经止痛

正确答案：E。活血化瘀，温经止痛

解析：题干中，患者产后即有小腹疼痛，拒按，得热痛缓，恶露量少，涩滞不畅，色紫暗有块，四肢不温，舌质紫暗，脉沉紧属于产后腹痛瘀滞子宫证的治法活血化瘀，温经止痛（E对）。产后腹痛气血两虚证证的治法补益气血，缓急止痛（A错）。题干中无气血不和表现（B错）。题干中无肝郁气滞表现C错）。题干中无肝肾亏虚表现（D错）。